下列药物中，具有药酶诱导作用的药物有
A. 卡马西平
B. 苯巴比妥
C. 氯霉素
D. 苯妥英钠
E. 利福平

正确答案：A、B、D、E。卡马西平；苯巴比妥；苯妥英钠；利福平

解析：本题考查具有药酶诱导作用的药物。卡马西平（A对）、苯巴比妥（B对）、苯妥英钠（D对）、利福平（E对）均具有药酶诱导作用，可提高肝药酶活性；氯霉素（C错）为肝药酶抑制剂。